关于医学模式的说法，下列说法不正确的是
A. 是一种医学观
B. 是指生物医学模式
C. 是以医学为对象的方法论
D. 是指导医学实践的基本观点

正确答案：B。是指生物医学模式

解析：本题考查医学模式的相关内容。医学模式是人类在与疾病抗争和认识自身生命过程的实践中得出的对健康观和疾病观等重要医学观念（A对）的本质概括。这种高度概括、抽象的思想观念和思维方法既表现了医学的总体结构特征，又是指导医学实践的基本观点（D对）。医学模式属于自然辩证法领域，是以医学为对象的自然观和方法论（C对），即人们按照唯物论和辩证法的观点和方法去观察、分析和处理有关人类的健康、疾病和死亡问题，是对健康和疾病现象的科学观。生物医学模式（B错，为本题正确答案）是指从生物学角度认识健康与疾病，反映病因、宿主和自然环境三者内在联系的医学观和方法论。